AG增高反映机体可能有
A. 呼吸性碱中毒
B. 呼吸性酸中毒
C. 正常血氯性代谢性酸中毒
D. 高血氯性代谢性酸中毒
E. 代谢性碱中毒

正确答案：C。正常血氯性代谢性酸中毒

解析：AG增高型代谢性酸中毒又称正常血氯代谢性酸中毒（C对）。